由自身抗体引起以骨骼肌进行性无力为特征的是
A. 自身免疫性血小板减少性紫癜
B. 自身免疫性中性粒细胞减少症
C. 重症肌无力
D. 肺出血肾炎综合征
E. 恶性贫血

正确答案：C。重症肌无力

解析：重症肌无力（MG）是一种由自身抗体引起的以骨骼肌进行性无力为特征的自身免疫性疾病。掌握“常见口腔自身免疫性疾病及自身免疫性疾病的治疗”知识点。